肾结石行体外冲击波碎石主要禁忌是
A. 高血压
B. 糖尿病
C. 前列腺增生
D. 结石急性发作
E. 输尿管狭窄

正确答案：E。输尿管狭窄

解析：体外冲击波碎石是上尿路结石常用的治疗方法，其原理是利用X线或B超定位结石，利用高能冲击波聚焦后作用于结石，使结石裂解，直至粉碎成细砂，随尿液排出体外。其主要禁忌症包括结石远端尿路梗阻（如输尿管狭窄）（E对）、妊娠、出血性疾病、严重心脑血管病等。前列腺增生（C错）、结石急性发作（D错）为肾结石行体外冲击波碎石的相对禁忌症。高血压（A错）、糖尿病（B错）不是体外冲击波碎石的禁忌症。